丙二醇可用于
A. 透皮促进剂
B. 气雾剂中的潜溶剂
C. 保湿剂
D. 增塑剂
E. 气雾剂中的稳定剂

正确答案：A、B、C、D。透皮促进剂；气雾剂中的潜溶剂；保湿剂；增塑剂

解析：本题考查片剂的包衣。丙二醇可用于透皮促进剂（A对）、气雾剂中的潜溶剂（B对）、保湿剂（C对）、增塑剂（D对），但并不起稳定剂作用（E错）。